支配双侧躯干肌的是
A. 皮质核束
B. 皮质脊髓前束
C. 皮质脊髓侧束
D. 额桥束
E. 红核脊髓束

正确答案：B。皮质脊髓前束

解析：皮质脊髓束在锥体下端，约75%-90%的纤维交叉至对侧，成为皮质脊髓侧束（C错），主要支配四肢肌。小部分未交叉的纤维称为皮质脊髓前束（B对），主要支配双侧躯干肌。皮质核束（A错）主要支配头面部肌肉。红核脊髓束（E错）主要影响肢体远端肌肉。